关于血尿描述正确的是
A. 尿沉渣高倍镜下视野红细胞＞5个
B. 尿沉渣低倍镜下视野红细胞＞5个
C. 尿沉渣高倍镜下视野红细胞＞3个
D. 尿沉法低倍镜下视野红细胞＞3个
E. 1000ml尿液含有10ml血浆可表现为肉眼血尿

正确答案：C。尿沉渣高倍镜下视野红细胞＞3个

解析：血尿分为肉眼血尿和显微镜下血尿。离心后尿沉渣镜检每高倍视野红细胞超过3个为显微镜下血尿（C对ABD错）。1L尿中含1ml血即呈现肉眼血尿（E错）。